关于打结中的需要注意的地方，以下说法错误的是
A. 打结收紧结扣时，要注意尽量使三点（两手用力点与结扎点）成一线
B. 组织缝合打好第1个结扣时，应将2根线头引向一侧，再打第2个结扣
C. 组织内结扎线头所留长度一般为1mm左右
D. 对深部组织的结扎，用手引线比较便捷
E. 打结时，每个结扣都必须是顺的，否则容易断线或结扎不紧

正确答案：D。对深部组织的结扎，用手引线比较便捷

解析：打结收紧结扣时，要注意尽量使三点（两手用力点与结扎点）成一线，否则结扎组织容易撕脱或结扎松脱。打结时，每个结扣都必须是顺的，否则容易断线或结扎不紧。组织缝合打好第1个结扣时，应将2根线头引向一侧，再打第2个结扣。对深部组织的结扎，用手引线颇感不便。此时可用长血管钳尖头持以游离线（俗称吊鱼线）横过结扎血管钳之尖端，扣住组织后引出，再行打结。组织内结扎线头所留长度一般为1mm左右，但对较大的血管及大块肌肉束等粗线结扎，为防止滑脱可增加到3～4mm。掌握“口外手术打结、缝合及外科引流”知识点。